透皮贴剂的用药指导内容包括
A. 用药前清洁贴敷部位的皮肤，并晾干
B. 打开透皮贴剂外包装，揭去附着的薄膜，贴于清洁的皮肤上
C. 不宜热敷
D. 不宜贴到破损、溃烂、渗出、红肿的皮肤上
E. 定期更换部位或遵医嘱

正确答案：A、B、C、D。用药前清洁贴敷部位的皮肤，并晾干；打开透皮贴剂外包装，揭去附着的薄膜，贴于清洁的皮肤上；不宜热敷；不宜贴到破损、溃烂、渗出、红肿的皮肤上

解析：本题考查各种剂型的正确使用。使用透皮贴剂时宜注意：①用前将所要贴敷部位的皮肤清洗干净，并稍稍晾干（A对）。②从包装内取出贴片，揭去附着的薄膜，但不要触及含药部位（B对）。③贴于无毛发或是刮净毛发的皮肤上，轻轻按压使之边缘与皮肤贴紧，不宜热敷（C对）。④皮肤有破损、溃烂、渗出、红肿的部位不要贴敷（D对）。⑤不要贴在皮肤的皱褶处、四肢下端或紧身衣服底下，选择一个不进行剧烈运动的部位。⑥定期更换或遵医嘱（E错）。